欲了解供水区居民介水传染病发病情况，应进行
A. 毒理实验
B. 水质检验
C. 水质卫生特征测定
D. 流行病学调查
E. 水源环境卫生调查

正确答案：D。流行病学调查

解析：本题考查流行病学调查。流行病学调查是一种研究疾病发生、流行和控制的科学方法，它可以帮助我们了解疾病的发生机制、流行规律和控制策略。因此，要了解供水区居民介水传染病发病情况，应进行流行病学调查（D对ABCE错）。